追踪测量某男孩9～19岁的身高和胸围，计算身高胸围指数。以下说法正确的是
A. 青春期突增高峰前，该男孩的身高胸围指数随年龄的增长而增长
B. 突增高峰时达最高值
C. 突增高峰后随年龄增长，身高胸围指数随年龄增长而下降
D. 青春期突增高峰前，该男孩的身高胸围指数不随年龄增长而变化
E. 以上说法全部错误

正确答案：E。以上说法全部错误

解析：身高胸围指数为：胸围/身高×100，反映胸廓发育状况，借以反映体型。青春期突增高峰前，该男孩的身高胸围指数随年龄的增长而降低，身高的增长速度快；突增高峰时未达最高值；突增高峰后随年龄增长，身高胸围指数随年龄增长而增长。